男，62岁，因房颤入院，用地高辛后心室率得到控制，并以0.5mg/d地高辛维持。因病人有心绞痛病史，为预防心绞痛而用一种抗心绞痛的药物，用药期间病人出现传导阻滞，你认为最可能是合并应用了哪种药物
A. 硝酸甘油
B. 硝苯地平
C. 维拉帕米
D. 硝酸异山梨酯
E. 美托洛尔

正确答案：C。维拉帕米

解析：维拉帕米口服适用于治疗：①各种类型心绞痛，包括稳定型或不稳定型心绞痛，以及冠状动脉痉挛所致的心绞痛，如变异型心绞痛；②房性过早搏动，预防心绞痛或阵发性室上性心动过速；③肥厚型心肌病；④高血压病。静注适用于治疗快速性室上性心律失常，使阵发性室上性心动过速转为窦性，使心房扑动或心房颤动的心室率减慢。口服用于治疗房性早搏或预防室上性心动过速发作。也用于治疗轻、中度高血压、肥厚性心肌病、口吃、食管痉挛和食管失弛缓症等。静脉推注用于中止阵发性室上性心动过速发作、房颤伴快速室率，也用于中止触发活动引起的极短联律或特发性尖端扭转型室性心动过速。本品对中止阵发性室上性心动过速奏效迅速，效果显著，为治疗室上性心动过速的首选药物。掌握“钙通道阻滞药分类及代表药物”知识点。